二级预防
A. 体检
B. 预防并发症
C. 术后护理
D. 术后康复锻炼
E. 开展健康教育工作

正确答案：A。体检

解析：在疾病的临床前期通过采取早期发现、早期诊断、早期治疗的“ 三早”预防措施，以控制疾病的发展和恶化即为第二级预防。在早期，可通过普查、筛检、定期健康检查、高危人群重点项目检查及设立专科门诊等方法发现疾病（A对）。（P6）第一级预防是指通过采取措施促进健康，或消除致病因素对机体危害的影响，以及提高机体的抵抗力来预防疾病的发生（E错）。（P7）第三级预防对已患某些疾病者，采取及时的、有效的治疗措施，终止疾病的发展、防止病情恶化、预防并发症和伤残；丧失劳动力或残废者，主要促使功能恢复、康复，进行家庭护理指导，使患者尽量恢复生活和劳动能力，能参加社会活动并延长寿命（BCD错）。